益母草善治的病症是
A. 痰瘀互阻水肿
B. 脾肾阳虚水肿
C. 水瘀互阻水肿
D. 寒湿下注水肿
E. 风水水肿

正确答案：C。水瘀互阻水肿

解析：益母草性味苦，辛，微寒，能利水消肿，且能活血调经，活血散瘀的功效较强，适用于水瘀互阻水肿（C对）；治疗痰瘀互阻水肿，当以消痰祛瘀兼以利水消肿，益母草虽有活血化瘀之功，却无祛痰之效（A错）；治疗脾肾阳虚的水肿，当以补益脾肾之阳为主，兼以利水消肿，益母草性味苦、辛，以活血，渗下利水为主，且性微寒，不宜用于脾肾阳虚的水肿（B错）；治疗寒湿下注水肿，当以散寒化湿兼以利水消肿，益母草性微寒，不能用于寒湿水肿（D错）；治疗风水水肿，治以疏风解表，宣肺行水，益母草无解表之功效（E错）。